手三阳经主治相同的是
A. 胸部病神志病
B. 咽喉病热病
C. 神志病热病
D. 前阴病妇科病
E. 神志病脏腑病，妇科病

正确答案：B。咽喉病热病

解析：手阳明经主治前头、鼻、口齿病，手少阳经主治侧头、胸胁病，手太阳经主治后头、肩胛、神志病。手少阳经和手太阳经共同主治耳病。手三阳经共同主治眼病、咽喉病、热病（B对）。